脂质体的制备方法不包括
A. 冷冻干燥法
B. 逆向蒸发法
C. 辐射交联法
D. 注入法
E. 超声波分散法

正确答案：C。辐射交联法